女，20岁。发热，咳嗽，咳脓痰三天。查体：体温38.6℃。左肺中下湿啰音，呼吸音减低。X线表现是左中下肺大片状致密阴影，内有液气平面，一周以前服用安定后，昏迷。经洗胃后治疗清醒，最可能的诊断是
A. 肺结核
B. 金黄色葡萄球菌肺炎
C. 急性肺脓肿
D. 军团菌肺炎
E. 克雷伯杆菌肺炎

正确答案：C。急性肺脓肿

解析：患者服用安定后，昏迷（吸入性肺脓肿的诱因），后高热，咳嗽，脓痰，左肺中下湿啰音，呼吸音减低（肺炎性感染表现）。X线表现是左中下肺大片状致密阴影，内有液气平面（肺脓肿典型X线表现），因此最可能的诊断是急性肺脓肿（C对）。肺结核（A错）常有低热、盗汗、乏力、消瘦等结核毒性症状，干、湿啰音多局限于上肺（P65）。金黄色葡萄球菌肺炎（B错）痰中带血，全身毒血症状明显，胸部X线检查显示肺段或肺叶实变，可早期形成空洞，或呈小叶状浸润，其中有单个或多发的液气囊腔，常引起血源性肺脓肿。军团菌肺炎（D错）高热、肌痛、相对缓脉，X线示下叶斑片浸润，进展迅速，无空洞。克雷伯杆菌肺炎（E错）起病急，寒战、高热、全身衰竭、咳砖红色胶冻状痰。X线示肺叶或肺段实变，蜂窝状脓肿，叶间隙下坠。